治疗高血压，还可用于治疗偏头痛和青光眼的药物是
A. 可乐定
B. 吲达帕胺
C. 依那普利
D. 甲基多巴
E. 米诺地尔

正确答案：A。可乐定

解析：本题考查可乐定。治疗高血压，还可用于治疗偏头痛和青光眼的药物是可乐定（A对）。可乐定适用于中度高血压。本药不影响肾血流量和肾小球滤过率，能抑制胃肠道腺体分泌和平滑肌运动，故适用于肾性高血压或兼患消化性溃疡的高血压患者。口服也可用于预防偏头痛或作为治疗吗啡类镇痛药成瘾者的戒毒药。其溶液剂滴眼用于治疗开角型青光眼。吲达帕胺（B错）为磺胺类利尿药，是目前应用比较广泛的利尿降压药，适用于轻、中度高血压，单独服用降压效果显著，不用加服其他利尿药。依那普利（C错）为血管紧张素转化酶抑制药（ACEI），是伴有左心室肥厚、左心功能障碍、急性心肌梗死、糖尿病肾病的高血压患者的首选药。甲基多巴（D错）是中枢性降压药，用于治疗高血压。米诺地尔（E错）为钾通道开放药，主要用于难治性的严重高血压，不宜单用，与利尿药和β受体阻断药合用，可避免水钠潴留和交感神经反射性兴奋。